反映糖尿病长期控制的指标
A. 空腹血糖
B. 血压
C. 糖化血红蛋白
D. 尿糖
E. 血清胰岛素水平

正确答案：C。糖化血红蛋白

解析：由于红细胞在血液循环中的寿命约为120天，因此糖化血红蛋白反映病人近8-12周平均血糖水平（C对）。空腹血糖（A错）升高是诊断糖尿病的主要依据，也是判断糖尿病病情和控制情况的主要指标。尿糖（D错）阳性是诊断糖尿病的重要线索。但尿糖阳性只是提示血糖值超过肾糖阈，因而尿糖阴性不能排除糖尿病可能，并发肾脏病变时，肾糖阈升高，虽然血糖升高，但尿糖阴性，肾糖阈降低时，虽然血糖正常，尿糖可阳性。血清胰岛素水平胰岛素是反映胰岛β功能的指标（E错）。血压（B错）用于是高血压病的重要诊断依据。